下列不属于茵陈药理作用的是
A. 保肝利胆
B. 抗炎镇痛解热
C. 抑制肿瘤
D. 兴奋平滑肌
E. 发汗平喘

正确答案：E。发汗平喘

解析：茵陈有明显的利胆退黄作用，可松弛胆道扩约肌、加速胆汁排泄；茵陈煎剂对肝损伤具有保护作用，可保护肝细胞膜、防止肝细胞坏死，促进其再生（A对）。茵陈中的主要成分6,7-二甲氧基香豆素具有抗炎镇痛解热的作用（B对）。茵陈对肿瘤细胞也有抑制作用（C对）。茵陈水煎剂对胃平滑肌具有兴奋作用（D对）。茵陈不具有发汗平喘的药理作用（E错，为本题正确答案）。